对二尖瓣狭窄程度的判定最有价值的是
A. 听诊
B. 胸部X线摄片
C. 心电图检查
D. 胸部CT扫描
E. 二维超声心动图检查

正确答案：E。二维超声心动图检查

解析：二维超声心动图检查（E对）是各种类型超声心动图发展的基础，超声造影、经食管超声均要建立在二维超声心动图像的基础上，可从二维空间显示心脏大血管不同方位的断层结构、毗邻关系与动态变化，是心脏超声的核心检查手段，适合于各种类型心血管疾病的检查，对二尖瓣狭窄程度的判定最有价值。听诊（A错）可大致推断二尖瓣瓣膜的情况。胸部X线摄片（B错）只能了解有无心脏增大，有无肺淤血。心电图检查（C错）主要是了解有无心脏缺血，有无心律失常，有无心肌肥厚。胸部CT（D错）可以对胸腔内占位性病变提供可靠的诊断依据。